结构中含有两个磺酰胺基的利尿药
A. 氨茶碱
B. 螺内酯
C. 氢氯噻嗪
D. 盐酸阿米洛利
E. 呋塞米

正确答案：C。氢氯噻嗪

解析：本题考查氢氯噻嗪的结构。结构中含有两个磺酰胺基的利尿药是氢氯噻嗪（C对）。氢氯噻嗪属苯并噻嗪类利尿药，为协同转运抑制剂，其结构中引入了两个磺酰胺基，利尿作用加强，类似的还有甲氯噻嗪、苄氟噻嗪等。氨茶碱（A错）属于磷酸二酯酶抑制剂，用作平喘药物。螺内酯（B错）含有甾体结构，是盐皮质激素受体阻断药，具有保钾利尿的作用。盐酸阿米洛利（D错）为留钾利尿药，是吡嗪衍生物。呋塞米（E错）为袢利尿剂，含有一个磺酰胺基。